在急性炎症中起关键作用的细胞是
A. 中性粒细胞
B. 红细胞
C. NK细胞
D. 巨噬细胞
E. 嗜碱性粒细胞

正确答案：A。中性粒细胞